蔬菜水果加工过程中损失的营养素主要是
A. 蛋白质
B. 脂肪
C. 淀粉
D. 膳食纤维
E. 维生素C

正确答案：E。维生素C

解析：本题考查蔬菜水果加工过程中损失的营养素。蔬菜水果加工过程中损失的营养素主要是维生素C（E对ABCD错）。